在选择饮用水水源时，为保证水质良好，水源水的总α放射性限值为
A. 0.1Bq/L
B. 0.2Bq/L
C. 0.5Bq/L
D. 1.0Bq/L
E. 1.5Bq/L

正确答案：A。0.1Bq/L

解析：本题考查饮用水水源选择的相关内容。在选择饮用水水源时，为保证水质良好，规定水源水的总α放射性限值为0.1Bq/L（A对BCE错），总β放射性值为1.0Bq/L（D错）。